片剂的黏合剂
A. PVP
B. PEG
C. A和B均用
D. A和B均不用

正确答案：C。A和B均用

解析：本题考查片剂的常用辅料。黏合剂系指依靠本身所具有的黏性赋予无黏性或黏性不足的物料以适宜黏性的辅料，常用的黏合剂有淀粉浆、甲基纤维素（MC）、羟丙基纤维素（HPC）、羟丙基甲基纤维素 （HPMC）、羧甲基纤维素（CMC-Na）、乙基纤维素（EC）、聚维酮（PVP）、明胶、聚乙二醇（PEG）等（C对）。